为抑制甲状腺功能亢进症患者甲状腺素的释放，外科手术前最常选择的药物是
A. 普萘洛尔
B. 卡比马唑
C. 甲巯咪唑
D. 丙硫氧嘧啶
E. 碘剂

正确答案：E。碘剂

解析：甲状腺素的释放指甲状腺球蛋白在蛋白水解酶作用下分解，释放出T4、T3进入血液的过程。该水解过程需消耗大量的还原型谷胱甘肽（GSH）。碘剂（E对）能抑制谷胱甘肽还原酶，减少细胞中GSH含量，从而抑制甲状腺素的释放。此外，大剂量碘剂还能拮抗TSH促进激素释放作用。普萘洛尔（A错）为β受体阻断剂，通过阻断β受体而改善甲亢所致的心率加快、心收缩力增强等交感活性症状，并不能抑制甲状腺素的释放。卡比马唑（B错）、甲巯咪唑（C错）、丙硫氧嘧啶（D错）为硫脲类抗甲状腺药物，通过抑制甲状腺过氧化物酶而减少甲状腺激素的合成，但并不抑制甲状腺素的释放。